某患者右上2左上1缺失，余牙正常。其固定义齿设计应采用
A. 半固定桥
B. 单端固定桥
C. 双端固定桥
D. 特殊固定桥
E. 复合固定桥

正确答案：E。复合固定桥

解析：比较常见的复合固定桥的设计是一个双端固定桥连接一个单端固定桥，或者是连接一个半固定桥。故修复体固定桥一般包含至少2个或3个至多个间隔基牙，包含4个或4个以上的牙单位。掌握“固定桥的生理基础”知识点。